中毒性菌痢表现为
A. 眼红腿痛淋巴结肿大
B. 血尿
C. 高热休克惊厥呼吸衰竭
D. 头痛腰痛眼眶痛
E. 相对缓脉

正确答案：C。高热休克惊厥呼吸衰竭

解析：急性中毒型菌痢多见2～7岁儿童。起病急骤，畏寒、寒战伴高热，全身中毒症状重，可伴有嗜睡、惊厥、抽搐，迅速出现循环衰竭和呼吸衰竭，而肠道症状不明显或缺如（C对）。